有一类发生于口腔内构成所谓Waldeyer环的淋巴组织内的囊肿，称为
A. 鼻唇囊肿
B. 鼻牙槽囊肿
C. 黏液囊肿
D. 根尖周囊肿
E. 口腔淋巴上皮囊肿

正确答案：E。口腔淋巴上皮囊肿

解析：有一类发生于口腔内的、具有与鳃裂囊肿相似组织学特点的囊肿，称为口腔淋巴上皮囊肿，这类囊肿发生于口腔内构成所谓Waldeyer环的淋巴组织内。掌握“鳃裂囊肿”知识点。